慢性阻塞性肺疾病急性发作最常见的原因是
A. 空气污染
B. 过敏
C. 感染
D. 治疗不规律
E. 气候变化

正确答案：C。感染

解析：慢性阻塞性肺疾病急性加重最常见的原因是细菌或病毒感染（C对），使气道炎症加重，气流受限加重，患者可自觉症状加重，严重者并发呼吸衰竭和右心衰竭。引起慢阻肺急性发作的其他原因包括吸烟、空气污染（A错）、吸入过敏原（B错）、气候变化（E错）、外科手术、治疗不规律（D错）等，并不是最常见的原因。